肾上腺素属于
A. 胆碱酯酶抑制药
B. M受体阻断药
C. α、β受体激动药
D. α受体阻断药
E. β受体阻断药

正确答案：C。α、β受体激动药

解析：本题考查肾上腺素。肾上腺素属于α、β受体激动药（C对），能使心肌收缩力加强、兴奋性增高，传导加速，心输出量增多。肾上腺素还可松弛支气管平滑肌及解除支气管平滑肌痉挛。